下列不属于十二指肠球部溃疡并发症的是
A. 急性穿孔
B. 幽门梗阻
C. 癌变
D. 出血
E. 慢性穿孔

正确答案：C。癌变

解析：消化性溃疡常见并发症有出血、穿孔、幽门梗阻和癌变。出血（D错）发生率为15％～25％；穿孔包括急性穿孔（A错）和慢性穿孔（E错），发生率为1％～5％；幽门梗阻（B错）发生率为2％～4％；溃疡由良性演变为恶性的几率很低，估计＜1％胃溃疡有可能癌变，十二指肠球部溃疡一般不发生癌变（C对）。